男，62岁，胸痛2个月。胸部X线片检查发现右上肺外周3.0cm×2.5cm阴影，下述检查对确定诊断最有价值的
A. 肿瘤标志物检测
B. CT或超声引导下经胸壁活检
C. 胸部MRI
D. 胸部CT
E. 支气管动脉造影

正确答案：B。CT或超声引导下经胸壁活检

解析：患者老年男性，胸痛2个月，X线片示右上肺外周肿块影，结合患者病史、临床表现和影像学检查，该患者最可能的诊断为周围型肺癌。患者有胸痛，提示肿块靠近胸壁，故为明确诊断，最有价值的是CT或超声引导下经胸壁穿刺活检（B对）。肿瘤标志物检测（A错）对肺癌的诊断特异性不高，故不选。胸部MRI（C错）、胸部CT（D错）为影像学检查方法，不能确诊肺癌。支气管动脉造影（E错）主要用于不明原因的反复大咯血及原发性肺癌需行支气管动脉灌注化疗者，一般不用做肺癌的诊断。